应将冻伤病人浸泡在多少温度的温水中以恢复其体温
A. 38～42度
B. 37度
C. 37～39度
D. 37度
E. 37～42度

正确答案：A。38～42度

解析：对于冻伤患者应该尽快恢复其体温，因此选择的水温应该略高于正常体温但又不能过高，以免引起烫伤，因此选择38～42度（A对）温水为宜。